釉质钙化不全型分类中哪一类更严重
A. 常染色体显性
B. 性染色体显性
C. 不分显性隐性
D. 性染色体隐性
E. 常染色体隐性

正确答案：E。常染色体隐性

解析：钙化不全型分常染色体显性、常染色体隐性两种亚型，染色体隐性型病变常更严重。掌握“釉质形成缺陷（釉质发育不全）”知识点。